来源于建筑材料和装饰材料的室内空气污染物不包括
A. 氡
B. TVOC
C. 甲醛
D. 氨
E. 军团菌

正确答案：E。军团菌

解析：本题考查来源于建筑材料和装饰材料的室内空气污染物。建筑材料和装饰材料中含有大量有机污染物及放射性污染物，对人体危害极大。来源于建筑材料和装饰材料的室内空气污染物包括氡（A对）、挥发性有机物（TVOC）（B对）、甲醛（C对）、氨（D对）等。军团菌（E错，为本题正确答案）主要来自于集中空调系统、淋浴设施、游泳池及喷泉等人工水环境中。